室内工作点与对面室外遮光物上端的连线与采光口，上缘连线之间的夹角为
A. 投射角
B. 开角
C. 采光系数
D. 室深系数
E. 窗地面积比

正确答案：B。开角

解析：本题考查开角。开角（B对）是室内工作点与对侧室外遮光物上端的连线和工作点与采光口上缘连线之间的夹角。投射角（A错）是指室内工作点与采光口上缘的连线和水平线所成的夹角。采光系数（C错）是指室内工作水平面上（或距窗1米处）散射光的照度与室外相同时间空旷无遮光物的地方接受整个天空散射光（全阴天，见不到太阳，但不是雾天）的水平面上照度的百分比。室深系数（D错）指居室进深与地板至窗上缘高度之比。窗地面积比（E错）指天然采光口的窗玻璃面积与室内地面面积之比。